有关类风湿关节炎和类风湿因子的描述正确的是
A. 类风湿因子阳性可诊断类风湿关节炎
B. 类风湿因子阴性可排除类风湿关节炎
C. 类风湿关节炎可出现类风湿因子阴性
D. 类风湿因子属于抗核抗体谱
E. 平时最常测定的类风湿因子为IgG

正确答案：C。类风湿关节炎可出现类风湿因子阴性

解析：类风湿因子在类风湿关节炎的阳性率约为80%，部分类风湿关节炎患者类风湿因子可为阴性，因此其阴性不能排除类风湿关节炎的诊断（C对B错）。类风湿因子并非类风湿关节炎的特异性抗体，其阳性可见于正常人及感染性、自身免疫性疾病等患者，因此类风湿因子阳性不能确诊类风湿性关节炎（A错）。抗核抗体谱主要包括抗核抗体、抗双链DNA抗体及抗可提取核抗原抗体，不包括类风湿因子（D错）。平时测定的类风湿因子为IgM，并不是IgG（E错）。